种植体植入术的并发症，哪项除外
A. 感染
B. 牙龈炎
C. 神经损伤
D. 窦腔黏膜穿通
E. 骨折

正确答案：E。骨折

解析：本题考查牙种植手术及效果评估。骨折（E错，为本题正确答案）不属于种植体植入术的并发症。种植体植入术的并发症：①创口裂开；②出血；③神经损伤（C对），下唇麻木；④窦腔黏膜穿通（D对）；⑤感染（A对）；⑥牙龈炎（B对）；⑦牙龈增生；⑧进行性边缘性骨吸收；⑨种植体创伤；⑩种植体机械折断。